具有CD3分子表面抗原的是
A. MΦ
B. T细胞
C. B细胞
D. NK细胞
E. 嗜碱性粒细胞

正确答案：B。T细胞